阴中求阳的适应证是
A. 阴虚
B. 阳虚
C. 阴盛
D. 阳盛
E. 阴阳两虚

正确答案：B。阳虚

解析：本题考查“阴中求阳”的治法，属于理解内容。补阳时适当佐以补阴药谓之阴中求阳，所以“阴中求阳”的治法适用于阳虚（B对）（CDE错）。补阴时适当佐以补阳药谓之阳中求阴（A错）。